第一胎，孕33周，重度子痫前期，决定能否期待治疗，下述哪项检查是不必要的
A. HPL测定
B. E3测定
C. NST或OCT检查
D. 宫颈粘液检查
E. L/S比值测定

正确答案：D。宫颈粘液检查

解析：宫颈粘液检查对了解月经周期和妊娠生理有一定帮助，对重度妊高征的治疗没有帮助。A项人胎盘催乳素(HPL)含量直接反映胎盘功能，足月妊娠HPL值为4～11mg/L，若该值＜4mg/L，或突然降低50%，提示胎盘功能低下。B项在妊娠后期，血浆中E3含量变化能反映胎儿、胎盘功能C项NST是无应激试验：是指在无宫缩、无外界负荷刺激下，对胎儿进行胎心率宫缩图的观察和记录，以了解胎儿储备能力；OCT是缩宫素激惹试验，又称为宫缩应急试验（CST）：其原理为诱发宫缩，并用胎儿监护仪记录胎心率变化，了解胎盘于宫缩时一过性缺氧的负荷变化，测定胎儿的储备能力。E项卵磷脂/鞘磷脂比值（L/S）表示肺成熟度，如比值≥2，表示胎儿肺成熟；＜1.5则表示胎儿肺尚未成熟，出生后可能发生新生儿呼吸窘迫综合征。掌握“娠期高血压疾病”知识点。